种植覆盖全口义齿在进行无牙颌患者修复设计的进行沟通和设计包括
A. 患者的要求
B. 患者的全身状况
C. 患者的口腔软硬组织条件
D. 患者的经济条件和预算
E. 以上说法均正确

正确答案：E。以上说法均正确

解析：在进行无牙颌患者修复设计时，应基于以下几点进行沟通和设计：①患者的要求。②患者的全身状况。③患者的口腔软硬组织条件。④患者的经济条件和预算。掌握“种植覆盖全口义齿”知识点。